食物嵌塞治疗中的选磨法适用于
A. 所有垂直型食物嵌塞
B. 部分垂直型食物嵌塞
C. 所有水平型食物嵌塞
D. 部分水平型食物嵌塞
E. B+C

正确答案：B。部分垂直型食物嵌塞

解析：本题考查食物嵌塞治疗中的选磨法。食物嵌塞治疗中的选磨法适用于一部分垂直型食物嵌塞（B对A错），如（牙合）面的过度磨损、边缘嵴或溢出沟已磨平、外展隙变窄或有充填式牙尖存在，而邻面接触关系基本正常的情况下，一般可通过磨改法来消除食物嵌塞，而由于邻面接触关系不良引起的食物嵌塞不能通过选磨法消除，对于邻面关系恢复不好的充填体或修复体应该重新制作或充填。垂直型食物嵌塞是由咬合力引起的，部分垂直型食物嵌塞可通过调（牙合）法得以解决；而水平型食物嵌塞（CD错）是由唇、颊和舌的压力引起的，不能通过调（牙合）法得以解决，多可采取自我护理的方法，如餐后用牙线或牙签剔除，用间隙刷等。